不适用于治疗慢性脓胸的术式是
A. 胸腔闭式引流术
B. 胸膜纤维板剥除术
C. 胸廓成形术
D. 肺叶切除术
E. 胸膜肺切除术

正确答案：A。胸腔闭式引流术

解析：胸腔闭式引流术适用于急性脓胸（A错，为本题正确答案）。慢性脓胸的手术治疗：1. 胸膜纤维层剥脱术（B对）：适用于病程不长，肺能复张的病例。若伴支气管胸膜瘘时，必须同时行足够范围的肺切除术（D对）。2. 胸膜肺切除术（E对）：适用于慢性脓胸伴广泛、严重、不可逆的肺内病变。3. 胸廓成形术（C对） ：适用于病程长的慢性脓胸，病侧肺已不能复张，或慢性结核性脓胸并支气管胸膜瘘，肺叶切除或全肺切除并发残腔感染者。